研究社会阶层与健康的意义主要在于
A. 探讨不同社会阶层人群的死亡谱和疾病谱
B. 发现弱势人群
C. 掌握公众医疗卫生服务需要量
D. 研究不同社会阶层人群的社会适应能力
E. 研究不同社会阶层人群的价值观念

正确答案：B。发现弱势人群